男性，28岁，因车祸颌面部外伤8小时后急诊。检查：患者左面部肿胀明显，眶周眼睑及结膜下淤斑、压痛，张口受限，张口度半指，咬合关系正常。可能的诊断是
A. 面部软组织挫伤
B. 下颌髁突骨折
C. 颧骨及颧弓骨折
D. 上颌骨骨折
E. 下颌骨体部骨折

正确答案：C。颧骨及颧弓骨折

解析：临床表现①颧面部塌陷：颧骨、颧弓骨折后骨折块移位方向主要取决于外力作用的方向，多发生内陷移位。在伤后早期，可见颧面部塌陷；随后，由于局部肿胀，塌陷畸形并不明显，易被误认为单纯软组织损伤；数日后肿胀消退，又出现局部塌陷。②张口受限：由于骨折块发生内陷移位，压迫颞肌和咬肌，阻碍冠突运动，导致张口疼痛和张口受限。③复视：颧骨构成眶外侧壁和眶下缘的大部分。颧骨骨折移位后，可因眼球移位，外展肌渗血和局部水肿以及撕裂的眼下斜肌嵌入骨折线中，限制眼球运动等原因而发生复视。④瘀斑：颧骨眶壁有闭合性骨折时，眶周皮下、眼睑和结膜下可有出血性瘀斑。⑤神经症状：颧骨上颌突部骨折移位可造成眶下神经损伤，致使该神经支配区有麻木感。骨折时如同时损伤面神经颧支，则发生眼睑闭合不全。掌握“颧骨及颧弓、眼眶骨折及骨折愈合过程”知识点。